全口义齿印模和模型的制作中，以下不正确的是
A. 在印模膏阴模的组织面和边缘均匀地刮除2mm左右
B. 灌注的模型厚度不超过10mm
C. 用铅笔画出两侧翼上颌切迹和腭小凹后2mm的连线
D. 用刀沿上述连线刻一深约1～1.5mm的沟
E. 沿上述的沟向前逐渐变浅刮除石膏，最宽处约5mm

正确答案：B。灌注的模型厚度不超过10mm

解析：本题考查全口义齿印模和模型的制作。全口义齿印模和模型的制作中，以下不正确的是灌注的模型厚度不超过10mm（B错，为本题的正确答案）。模型边缘厚度以3～5mm为宜，模型最薄处不能少于10mm。在印模膏阴模的组织面和边缘均匀地刮除2mm左右（A对）；用铅笔画出两侧翼上颌切迹和腭小凹后2mm的连线（C对）；用刀沿上述连线刻一深约1～1.5mm的沟（D对）；沿上述的沟向前逐渐变浅刮除石膏，最宽处约5mm（E对）均是对全口义齿印模和模型制作的正确描述。